内痔的主要临床表现是
A. 流脓
B. 周期性疼痛
C. 脓血便
D. 便血
E. 便秘

正确答案：D。便血

解析：内痔以无痛性便血为主要症状，血液与大便不相混，多在排便时滴血或射血。出血呈间歇性，每因饮酒、过劳、便秘或腹泻时使便血复发和加重。出血严重时可引起贫血（D对）。流脓多有细菌感染、炎症化脓引起，内痔一般无此类表现（A错）。周期性疼痛为肛裂主要临床表现（B错）。脓血便指大便中混有脓状物质及血液。原因是肠道有炎症或受外界刺激，如细菌性痢疾，炎症性肠病等均可以造成肠道的黏膜受损，出现脓血便（C错）。便秘除了受年龄、生活习惯等因素影响外，一些肠道的病变，如炎症性肠病、肿瘤、疝、直肠脱垂等，此类病变导会致功能性出口梗阻引起排便障碍，引起便秘（E错）。